与明胶作用后形成水不溶性沉淀的是
A. 木脂素
B. 香豆素
C. 黄酮
D. 皂苷
E. 鞣质

正确答案：E。鞣质

解析：本题考查中药的提取方法。与明胶作用后形成水不溶性沉淀的是鞣质（E对）。与蛋白质沉淀：鞣质能与蛋白质结合产生不溶于水的沉淀，能使明胶从水溶液中沉淀，使生皮成革，这种性质可作为提纯、鉴别鞣质的一种方法。木脂素（A错）类化合物的提取分离方法：溶剂法、碱溶酸沉法、色谱法。香豆素（B错）类化合物的提取方法：香豆素类成分多以亲脂性的游离形式存在于植物中，可以用一般的有机溶剂，如乙醚、三氯甲烷、丙酮等提取，而香豆素苷类因极性增大而具亲水性，可选亲水性溶剂，如甲醇、乙醇或水提取。黄酮（C错）类化合物的提取方法：大多数游离的黄酮类化合物宜用极性较小的溶剂，如用三氯甲烷、乙醚、乙酸乙酯等提取，而对多甲氧基黄酮，甚至可用苯进行提取。提取萜苷（D错）类多用甲醇或乙醇为溶剂，也可用水、稀丙酮及乙酸乙酯，提取液经减压浓缩后加水溶解，滤去水不溶性杂质，用乙醚、三氯甲烷或石油醚萃取去除脂溶性杂质。